易导致主动脉瓣狭窄患者晕厥的情况为
A. 服用硫氮卓酮
B. 静坐休息
C. 剧烈运动
D. 睡眠
E. 窦性心率，心率70次/分

正确答案：C。剧烈运动

解析：主动脉瓣狭窄患者出现晕厥多发生于剧烈运动（C对）时，仅有极少数在静坐休息（B错）或睡眠时发生（D错）。机制可能为剧烈运动时，外周血管扩张而心排出量不能相应增加，同时心肌缺血加重，心肌收缩力减弱引起心排出量的进一步减少，脑供血不足而出现晕厥症状。硫氮䓬酮（A错）即地尔硫䓬，为非二氢吡啶类钙拮抗剂，虽然也可以扩张外周血管，但同时能扩张冠状动脉，改善心肌缺血，心排出量不会骤减，因此较少导致主动脉瓣狭窄患者出现晕厥。窦性心率，心率70次/分（E错）为正常情况，与晕厥的出现无关。